下列不由椎动脉的供血的部位是
A. 大脑半球前2/3
B. 大脑半球后1/3
C. 部分间脑
D. 脑干和小脑
E. 无

正确答案：A。大脑半球前2/3

解析：脑的动脉来源于颈内动脉和椎动脉，大脑半球后1/3（A对） 及部分间脑（C对）、脑干和小脑（D对）由椎动脉供血，而大脑半球的前2/3（A错，为本题正确答案）由颈内动脉供血。